抢救CO中毒时，纠正缺氧疗法
A. 静脉注射甘露醇、葡萄糖、速尿
B. 吸氧、高压氧舱疗法
C. 药物冬眠，给予ATP及细胞色素C
D. 保持呼吸道通畅，翻身及抗生素的应用
E. 立即将病人移到空气新鲜的地方

正确答案：B。吸氧、高压氧舱疗法

解析：抢救CO中毒时纠正缺氧的方法有吸氧、高压氧舱疗法（B对）。吸入氧气可加速COHb解离。增加CO的排出，吸入新鲜空气时，CO由COHb释放出半量约需4小时；吸入纯氧时可缩短至30~40分钟，吸入3个大气压的纯氧可缩短至20分钟。高压氧舱治疗能增加血液中溶解氧，提高动脉血氧分压，使毛细血管内的氧容易向细胞内弥散，可迅速纠正组织缺氧。